一更年期妇女，到医院咨询更年期保健的相关问题，对她的保健建议不应该包括
A. 经常服用保健药品
B. 鼓励适量运动
C. 定期健康检查
D. 接受健康教育及卫生指导
E. 必要时性激素治疗

正确答案：A。经常服用保健药品

解析：本题考查更年期的保健内容。更年期妇女可适当吃保健品，补充营养物质，但无需经常吃（A错，为本题正确答案）。更年期的保健很广泛：鼓励适量运动（B对）、定期健康检查（C对）、接受健康教育及卫生指导（D对）、必要时性激素治疗（E对）这些保健建议都是正确的，可以在医师指导下适量摄入维生素、钙、铁等元素的补充剂，但是不应自己滥用市场上出售的各种保健品。